患儿，女，4岁半，身高110cm，体重15kg。一天前开始发热（39.1℃），咽稍痛，无咳嗽，无吐泻，家长在家选用退烧药对症治疗。发病20h左右出现腹泻，约2～3h一次大便，量少，黄色黏液便，呕吐1次。体格检查：T38.8℃，P118次/分，R28次/分，咽微充血，出现轻微脱水症状。双肺呼吸音清，腹平，肝脾未触及，肠鸣音活跃，实验室检查：WBC18.5×10⁹/L（参考值4.0×10⁹～10.0×10⁹/L），粪便镜检可见红、白细胞。关于该患儿腹泻用药注意事项的说法，错误的是
A. 药用炭可以吸附细菌和毒素，可与抗生素同时服用
B. 腹泻可致电解质丢失，故需特别注意补充
C. 小檗碱和鞣酸蛋白不宜同时服用
D. 首选口服补液，必要时静脉补液
E. 适时使用微生态制剂

正确答案：A。药用炭可以吸附细菌和毒素，可与抗生素同时服用

解析：本题考查腹泻用药注意事项。药用炭可影响儿童的营养吸收，也能吸附维生素、抗生素、生物碱、乳酶生及各种消化酶，影响疗效，严重腹泻时禁用（A错，为本题正确答案）。